身体无病，月经定期2个月一潮者，称为
A. 居经
B. 并月
C. 暗经
D. 激经
E. 避年

正确答案：B。并月

解析：身体无病，而月经定期2个月来潮一次者，称为并月（B对）。三个月来潮一次者，称为居经或季经（A错）。终身不潮而却能受孕者称为暗经（C错）。受孕初期仍能按月经周期有少量出血而无损于胎儿者，称为激经（D错）。一年一行者称为避年（E错）。